黄体酮用于治疗输尿管结石症属于
A. 无适应证用药
B. 超适应证用药
C. 有禁忌症用药
D. 过度治疗用药
E. 盲目联合用药

正确答案：B。超适应证用药

解析：本题考查超适应证用药。黄体酮用于治疗输尿管结石症属于超适应证用药（B对）。黄体酮说明书中并未提及用于结石，故属于超适应证用药。无适应证用药（A错）是指在制定治疗方案和开具处方时，药物的适应证与患者病理、病因、病情、临床诊断不相符。有禁忌症用药（C错）是指忽略药品说明书的提示及忽略病情和患者的基础疾病。过度治疗用药（D错）是指滥用抗菌药、糖皮质激素、人血白蛋白、二磷酸果糖及肿瘤补助治疗药，还包括无治疗指征盲目补钙等。盲目联合用药（E错）是指联合应用药物而无明确的指证。